C1酯酶抑制剂缺乏会导致
A. 原发性B细胞缺陷
B. 重症联合免疫缺陷
C. 原发性补体缺陷
D. 遗传性血管神经性水肿
E. 多发性骨髓瘤

正确答案：D。遗传性血管神经性水肿

解析：C1酯酶抑制剂又称C1抑制物（C1INH），是一种血浆中正常存在的丝氨酸蛋白酶抑制剂，在补体系统和凝血系统中具有重要调节作用，C1酯酶抑制剂缺乏时会导致遗传性血管神经性水肿（D对），患者表现为反复发作的皮肤黏膜水肿。原发性B细胞缺陷（A错）是B细胞先天性发育不全，或由于B细胞对T细胞传递的信号反应缺陷，而导致抗体产生减少的一类疾病。重症联合免疫缺陷（B错）（P166）多见于新生儿和婴幼儿，出生后不久严重呼吸道感染、慢性腹泻、夭折。原发性补体缺陷（C错）（P166）多为常染色体隐性遗传，在补体系统中，参与补体激活的固有成分、补体调节蛋白或补体受体中任一成分缺陷均可导致此类疾病。多发性骨髓瘤（E错）是恶性浆细胞病，常伴有多发性溶骨性损害、高钙血症、贫血和肾脏损害等。